男，34岁，左上第三磨牙阻生颊侧移位，要求拔除。行上齿槽后神经阻滞麻醉后左面颊部立即肿胀。可能的诊断是
A. 注射麻药过量
B. 翼静脉丛损伤
C. 颊间隙感染
D. 注射区水肿
E. 过敏反应

正确答案：B。翼静脉丛损伤

解析：本题考查局麻的并发症-血肿。翼丛位于颞下窝，相当于上颌结节后上方处，向后汇集形成上颌静脉，在施行上牙槽后神经传导阻滞麻醉时，应正确掌握进针方向、角度及深度，避免刺破翼丛而发生血肿（B对）。注射麻药过量可导致患者出现中毒反应，兴奋性表现为烦躁不安、颤抖、恶心、呕吐，严重者出现全身抽搐、缺氧、发绀；抑制型可导致患者出现脉搏细弱、血压下降、神志不清（A错）。颊间隙感染常由上、下颌磨牙的根尖脓肿或牙槽脓肿穿破骨膜，侵入颊间隙；或颊部皮肤损伤继发感染而引起（C错）。注射区有水肿可能是过敏反应的表征，表现为注射区的肿胀，但不会立即出现（D错）。过敏反应可分为延迟型和即刻反应，延迟型主要表现为血管神经性水肿，即刻反应可表现为类似中毒的症状，出现惊厥（E错）。